对淋病奈瑟菌叙述错误的是
A. 为G-双球菌
B. 菌毛为主要致病物质
C. 分离培养用巧克力血琼脂平板
D. 可引起淋病和新生儿脓漏眼
E. 抵抗力强

正确答案：E。抵抗力强